可用水蒸气蒸馏法提取的生物碱是
A. 羟基苦参碱
B. 伪麻黄碱
C. 巴马丁
D. 表小檗碱
E. 士的宁

正确答案：B。伪麻黄碱

解析：本题考查的是水蒸气蒸馏法。可用水蒸气蒸馏法提取的生物碱是伪麻黄碱（B对）。水蒸气蒸馏法用于提取能随水蒸气蒸馏而不被破坏的难溶于水的成分。这类成分有挥发性，可随水蒸气逸出，冷凝后可用油水分离器或有机溶剂萃取法将该类成分自馏出液中分离。中药挥发油及某些具挥发性的小分子生物碱、小分子酚性物质等均可应用本法提取。水蒸气蒸馏法设备简单、易于操作且提油率高，但不适宜提取某些对热不稳定或对嗅味有特别要求的挥发油成分。挥发性生物碱如麻黄碱可用水蒸气蒸馏法提取。羟基苦参碱（A错）为苦参的主要化学成分。苦参中主要生物碱及其化学结构：苦参所含主要生物碱是苦参碱和氧化苦参碱，《中国药典》以其为指标成分进行鉴别和含量测定，含量测定要求苦参碱和氧化苦参碱总量不得少于1.2%。此外还含有羟基苦参碱、N-甲基金雀花碱、安那吉碱、巴普叶碱和去氢苦参碱（苦参烯碱）等。这些生物碱都属于双稠哌啶类。巴马丁（C错）与表小檗碱（D错）为黄连的主要化学成分。黄连的有效成分主要是生物碱，已经分离出来的生物碱有小檗碱（含量最高）、巴马汀、黄连碱、甲基黄连碱、药根碱和木兰碱（属于阿朴菲型）等；大多属苄基异喹啉类衍生物，季铵型生物碱。《中国药典》以小檗碱为指标成分进行含量测定。以盐酸小檗碱计，要求味连含小檗碱不得少于5.5%，表小檗碱不得少于0.80%，黄连碱不得少于1.6%，巴马汀不得少于1.5%；要求雅连含小檗碱不得少于4.5%；要求云连含小檗碱不得少于7.0%。马钱子成熟种子中生物碱含量为1.5%～5%，主要生物碱是士的宁（E错）（又称番木鳖碱）、马钱子碱及其氮氧化物，还含少量的10余种其他吲哚类生物碱，其中以士的宁含量居首，占总碱量的35%～50%，其次是马钱子碱，占总碱量的30%～40%。《中国药典》以士的宁和马钱子碱为指标成分进行含量测定，要求士的宁的含量应为1.20%～2.20%，马钱子碱的含量不得少于0.80%。马钱子含生物碱主要是士的宁和马钱子碱，前者约占总生物碱的45%，是主要的有效成分亦是有毒成分，成人用量5～10mg可发生中毒现象，30mg可致死。